咽—结合膜热的病原体为
A. 流感病毒
B. 合胞病毒
C. 柯萨奇病毒
D. 腺病毒
E. EB病毒

正确答案：D。腺病毒

解析：腺病毒3、7型为咽结合膜热的病原体（D对）。流感病毒、副流感病毒引起流行性感冒（A错）。呼吸道合胞病毒是毛细支气管炎的主要病原体（B错）。柯萨奇A组病毒为疱疹性咽峡炎的病原体（C对）。EB病毒（EBV）为传染性单核细胞增多症（IM）的病原体（E错）。